女，45岁。右面部疖肿10天，多次挤压排脓。今突发寒战高热伴头晕，无抽搐。查体：T40℃，R26次/分，BP100/70mmHg。右面部肿，口唇无偏斜，胸壁及肢体皮下可见出血斑，血WBC20×10⁹/L，核左移。该患者目前的诊断是
A. 右腮腺脓肿
B. 菌血症
C. 感染性休克
D. 颅内感染
E. 脓毒症

正确答案：E。脓毒症

解析：患者对面部疖多次挤压排脓后，出现高热、寒战、皮下出血斑等全身症状，实验室检查WBC明显升高（正常值为4～10×10⁹/L），提示是由于面部疖肿处理不当引发的全身性感染（包括菌血症、脓毒症等）。脓毒症（七版黄家驷外科学P117）的确诊必须具备两个条件：①有活跃的细菌感染的确实证据，但血培养不一定为阳性；②有SIRS，即全身性炎症反应综合征。SIRS的四项标准符合两项即可诊断：体温＞38℃或＜36℃；心率＞90次/分；呼吸＞20次/分或有过度通气致PaCO₂＜4.3（32mmHg）；白细胞计数＞12×10⁹/L或＜4×10⁹/L，或幼稚细胞＞0.10。该患者有活跃的细菌感染的确实证据（突发寒战、高热，胸壁及肢体皮下可见出血斑），有SIRS（T40℃，R26次／分，血WBC20×10⁹/L）。综上，该患者目前的主要诊断是脓毒症（E对）。右腮腺脓肿主要表现为右侧面部的肿胀和疼痛，而不会出现皮下出血瘀斑（A错）。菌血症（B错）（P114）的诊断依据是血培养阳性，本题并未明确提出。该患者血压BP100/70mmHg，无外周循环不足的各种表现，未达到休克标准，故不能诊断为感染性休克（C错）。颅内感染主要症状为发热、头疼、恶心、呕吐等，一般不出现瘀斑。（D错）。